食品卫生监督员在执行监督任务时，判定食品和食品添加剂是否符合卫生要求的依据是
A. 食品的毒理学安全性评价资料
B. 食品卫生检验方法
C. 食品卫生管理措施
D. 企业卫生规范
E. 食品卫生标准

正确答案：E。食品卫生标准